男，28岁，图书馆管理员，今整理图书馆图书期间出现突发咳嗽，气喘，呼吸困难，既往过敏性鼻炎，查体：双肺哮鸣音，无心脏病体征。该患者考虑什么疾病
A. 急性左心衰
B. 支气管哮喘
C. 支气管炎
D. 支气管肺炎
E. 肺炎

正确答案：B。支气管哮喘

解析：根据题干症状：突发咳嗽、咳痰、气喘同时伴有呼吸困难，再根据患者既往有过敏性鼻炎，以及体征：双肺哮鸣音，诊断考虑支气管哮喘急性发作期（B对）。急性左心衰：突发严重呼吸困难，呼吸频率常达30～50次/分，强迫坐位、面色灰白、发绀、大汗、烦躁，同时频繁咳嗽，咳粉红色泡沫状痰。极重者可因脑缺氧而致神志模糊。发病伊始可有一过性血压升高，病情如未缓解，血压可持续下降直至休克。听诊时两肺满布湿性啰音和哮鸣音，心尖部第一心音减弱，率快，同时有舒张早期第三心音奔马律，肺动脉瓣第二心音亢进（A错）。支气管炎、支气管肺炎、肺炎的体征一般出现湿啰音（CDE错）。